应用伯氨喹引起的溶血性贫血属于
A. 变态反应
B. 后遗效应
C. 毒性反应
D. 特异质反应
E. 副作用

正确答案：D。特异质反应

解析：本题考查药品的不良反应。应用伯氨喹引起的溶血性贫血属于特异质反应（D对）。特异质反应是指少数特异体质患者对某些药物反应异常敏感。例如，先天性葡萄糖-6-磷酸脱氢酶（G-6-PD）缺乏的疟疾患者服用伯氨喹后，容易发生急性溶血性贫血和高铁血红蛋白血症。变态反应（A错）是指机体受药物刺激所发生异常的免疫反应，引起机体生理功能障碍或组织损伤，又称为过敏反应。后遗效应（B错）是指在停药后血药浓度已降低至最低有效浓度以下时仍残留的药理效应。毒性作用（C错）是指在药物剂量过大或体内蓄积过多时发生的危害机体的反应。副作用（E错）是指在药物按正常用法用量使用时，出现的与治疗目的无关的不适反应。